患者头痛恶寒，身重疼痛，面色淡黄，胸闷不饥，午后身热，状若阴虚，病难速已，名曰
A. 湿温
B. 瘟疫
C. 风温
D. 冬温
E. 温热

正确答案：A。湿温

解析：湿温病多发于夏秋之交，其起病较缓，传变较慢，病情缠绵难愈。湿温初起见头痛恶寒，身重疼痛，面色淡黄，胸闷不饥，较著，舌苔白腻，口不渴，脉弦细而濡等症状（A对）。